下列哪个位置一般不发生血管神经性水肿
A. 舌
B. 唇
C. 眼睑
D. 上腭
E. 咽喉部

正确答案：D。上腭

解析：本题考查血管神经性水肿的好发部位。上腭（D错，为本题的正确答案）部位组织致密，不易发生血管神经性水肿。血管神经性水肿为一种急性局部反应型的黏膜皮肤水肿，病变好发部位为为头面部疏松结缔组织处，如唇（B对）、舌（A对）、颊、眼睑（C对）、耳垂、咽喉部（E对）。